关于肾筋膜的描述，错误的是
A. 位于脂肪囊的外周
B. 为肾单独的被膜
C. 分前后两层
D. 在肾的下方两层分开
E. 输尿管由其下方的开口通过

正确答案：B。为肾单独的被膜

解析：肾的被膜有三层（B错，为本题正确答案）：纤维囊、脂肪囊与肾筋膜。肾筋膜位于脂肪囊的外面（A对），分为肾前筋膜和肾后筋膜（C对），两者在肾的下方则互相分离（D对），其中有输尿管通过（E对），因肾筋膜下方完全开放，当腹壁肌力弱、肾周脂肪少、肾的固定结构薄弱时，可产生肾下垂。